脾为气血生化之源的理论基础是
A. 气能生血
B. 人以水谷为本
C. 脾主升清
D. 脾能运化水谷精微
E. 脾为后天之本

正确答案：D。脾能运化水谷精微

解析：气能生血是指血液的生化离不开气作为动力，是气与血的关系（A错）。人以水谷为本是指人依靠水谷的营养而生存（B错）。脾主升清指的是脾气的升动，将胃肠吸收的水谷精微和水液上输于心肺等脏，通过心肺的作用化生气血，以营养濡润全身（C错）。人出生后，全赖于脾胃运化的水谷精微以化生气血来维持生命活动，故称脾胃为后天之本，气血生化之源（D对）。脾为后天之本与脾为气血生化之源意思相同（E错）。